根据细菌胞壁糖类抗原将变形链球菌分为a～h共8个血清型，其中在人类检出率最高的血清型为
A. acf
B. def
C. cef
D. dce

正确答案：C。cef

解析：本题考查致龋微生物-变异链球菌。根据细菌胞壁糖类抗原将变形链球菌分为ａ～ｈ共8个血清型，其中在人类检出率最高的血清型为cef（C对），这三型的人类检出率近90%。其他各种血清型变异链球菌均应视为另外的独立菌种。d、g、h血清型变异链球菌的人类检出率为9%。a血清型主要在仓鼠中检出，命名为仓鼠链球菌。b型主要在大鼠中检出，称为鼠链球菌。